用于各种原因所致的中枢性呼吸抑制的急救药是
A. 咖啡因
B. 尼可刹米
C. 士的宁
D. 哌甲酯
E. 匹莫林

正确答案：B。尼可刹米